下列各项，不是血虚证临床表现的是
A. 经少经闭
B. 头晕眼花
C. 心烦失眠
D. 面色淡白
E. 肢体麻木

正确答案：C。心烦失眠

解析：血虚证是由于各种原因引起的血液亏虚，进而导致冲任血海亏虚，经血乏源，少血或无血可下，而致经少经闭（A错）。血虚不能上荣头目可见头晕眼花（B错），面色淡白（D错）。心烦失眠多因心神受扰，而血虚引起的是心神失养，多导致多梦、健忘（C对）。血液亏虚，不能濡养四肢，可见肢体麻木（E错）。